用于抗消化道溃疡的抑酸剂包括
A. 质子泵抑制剂
B. 胆碱受体抑制剂
C. 组胺H₂受体抑制剂
D. 胃黏膜保护剂
E. 胃泌素抑制剂

正确答案：A、B、C、E。质子泵抑制剂；胆碱受体抑制剂；组胺H₂受体抑制剂；胃泌素抑制剂

解析：本题考查抑酸剂。用于抗消化道溃疡的抑酸剂包括质子泵抑制剂（A对）、胆碱受体抑制剂（B对）、组胺H₂受体抑制剂（C对）、胃泌素抑制剂（E对）。胃黏膜保护剂（D错）为抗消化性溃疡药，不属于抑酸剂。